艾滋病英文为AIDS，其中文全称是
A. 先天性免疫缺陷综合征
B. 获得性免疫缺陷综合征
C. 获得性病毒免疫综合征
D. 获得性病毒免疫综合征
E. 先天性获得免疫综合征

正确答案：B。获得性免疫缺陷综合征

解析：艾滋病又称获得性免疫缺陷综合征，简称AIDS。掌握“艾滋病的口腔表现”知识点。